属于阴离子型表面活性剂的是
A. 聚山梨酯80
B. 司盘80
C. 卵磷脂
D. 新洁尔灭
E. 月桂醇硫酸钠

正确答案：E。月桂醇硫酸钠